菊花的药用部位是
A. 花萼
B. 柱头
C. 雄蕊
D. 花蕾
E. 头状花序

正确答案：E。头状花序

解析：本题考查的是菊花的来源。菊花的药用部位是头状花序（E对）。菊花：【来源】为菊科植物菊的干燥头状花序。花萼（A错）的槐花药材的一部分。槐花：【来源】为豆科植物槐的干燥花及花蕾。槐花药材完整者花萼钟状。药用部位为柱头（B错）的中药为西红花。西红花：【来源】为鸢尾科植物番红花的干燥柱头。药用部位为雄蕊（C错）的中药为莲须。药用部位为花蕾（D错）的中药为辛夷。辛夷：【来源】为木兰科植物望春花、玉兰或武当玉兰的干燥花蕾。